因正畸需要拔除牙齿，将误拔除的牙齿立即放回牙槽窝内的方法属于
A. 自体牙移植术
B. 异体牙移植术
C. 即刻再植
D. 延期再植
E. 牙种植术

正确答案：C。即刻再植

解析：牙再植术是将因种种原因脱位的牙经处理后，原位植入牙槽窝内。分即刻再植和延期再植两种，后者极少应用。掌握“牙槽外科”知识点。